患者，女，9个月。秋季发病，呕吐伴腹泻2天，每天大便6～9次，为蛋花样无腥臭味，哭时有泪，尿量减少。查体：精神好，心肺无异常，腹稍胀，皮肤弹性尚可。最可能的诊断是
A. 轮状病毒肠炎
B. 真菌性肠炎
C. 大肠杆菌性肠炎
D. 空肠弯曲菌肠炎
E. 假膜性小肠结肠炎

正确答案：A。轮状病毒肠炎

解析：9个月小儿（轮状病毒肠炎是婴儿腹泻最常见的疾病，多发生在6～24个月的婴幼儿），呕吐、腹泻，为蛋花汤样无腥臭味（轮状病毒典型大便特点为黄色水样或蛋花汤样便），哭时有泪，尿量减少（轻度脱水表现）。查体：精神好，心肺无异常，腹稍胀，皮肤弹性尚可。综合患儿病史、症状，可诊断为轮状病毒肠炎（A对）。真菌性肠炎（B错）常并发于其他感染或肠道菌群失调时，常伴鹅口疮，大便泡沫多，带黏液，可见豆腐渣样细块，大便镜检有真菌孢子和菌丝。大肠杆菌肠炎（C错）常表现为高热、呕吐、腹痛，腹泻频繁，大便呈黏液状，带脓血，有腥臭味，大便镜检有大量白细胞。空肠弯曲菌肠炎（D错）常侵犯空肠和回肠，有脓血便，腹痛剧烈，亦误诊为阑尾炎。假膜性小肠结肠炎（E错）由难辨梭状芽胞杆菌引起。表现为腹泻，重症频泻，为黄绿色水样便，可有假膜排出，伴有腹痛、腹胀和全身中毒症状，甚至休克。